遴选非处方药的主要原则是
A. 慎重从严
B. 结合国情
C. 突出特色
D. 疗效确切
E. 中西药并重

正确答案：D。疗效确切